磺胺增效剂是
A. 诺氟沙星
B. 磺胺米隆甲磺灭脓
C. 磺胺嘧啶
D. 甲硝唑
E. 甲氧苄啶

正确答案：E。甲氧苄啶

解析：甲氧苄啶是二氢叶酸还原酶抑制剂。口服吸收迅速而完全。抗菌谱与磺胺类相似，抗菌作用较强，单用易产生耐药性。其抗菌机制是抑制细菌二氢叶酸还原酶，阻碍四氢叶酸合成。与磺胺合用可使细菌叶酸代谢受到双重阻断，抗菌作用增加数倍至数十倍，甚至出现杀菌作用，且可减少耐药性产生，对已耐药菌亦有作用。TMP还可以增强四环素、庆大霉素等多种抗生素的抗菌作用（E对）。